某男，17岁，暑湿季节，突发泄泻腹痛，变黄而黏，肛门灼热，舌质红，苔黄薄腻，脉滑数。葛根芩连丸处方中的葛根，除能升阳止泻外，又能
A. 解肌退热
B. 清热解毒
C. 清热燥湿
D. 益气生津
E. 凉血止血

正确答案：A。解肌退热

解析：本题考查的是葛根的功效。葛根芩连丸处方中的葛根，除能升阳止泻外，又能解肌退热（A对）。葛根：【功效】解肌退热，透疹，生津，升阳止泻。菊花：【功效】疏散风热，平肝明目，清热解毒（B错）。黄柏：【功效】清热燥湿（C错），泻火解毒，退虚热。五味子：【功效】收敛固涩，益气生津（D错），滋肾宁心。桑叶：【功效】疏散风热，清肺润燥，平肝明目，凉血止血（E错）。